除（牙合）面外，龋损最易好发部位是
A. 腭面
B. 唇面
C. 颊面
D. 舌面
E. 邻面

正确答案：E。邻面

解析：本题考查龋病的临床表现与分类。龋的好发牙面依次为（牙合）面、邻面（E对）、颊面、牙颈部根面。